属于处方药的有
A. 病情较重，需经医师诊断治疗的药品
B. 新药保护及专利保护期的药品
C. 可以在大众传播媒介作广告宣传的药品
D. 治疗小伤小病，解除症状的药品
E. 需按特殊药品要求管理的药品

正确答案：A、B、E。病情较重，需经医师诊断治疗的药品；新药保护及专利保护期的药品；需按特殊药品要求管理的药品